第一个选择性表皮生长因子受体酪氨酸激酶抑制剂，分子中含有3-氯-4-氟苯胺基团，用于治疗非小细胞肺癌和转移性非小细胞肺癌的药物是
A. 吉非替尼
B. 伊马替尼
C. 阿帕替尼
D. 索拉替尼
E. 埃克替尼

正确答案：A。吉非替尼

解析：本题考查吉非替尼。吉非替尼（A对）是第一个选择性表皮生长因子受体酪氨酸激酶抑制剂，用于非小细胞肺癌、转移性非小细胞肺癌治疗。甲磺酸伊马替尼（B错）是第一个上市的蛋白酪氨酸激酶抑制剂，用于治疗费城染色体阳性的慢性粒细胞白血病和恶性胃肠道间质肿瘤。阿帕替尼（C错）是国内企业研发的抗肿瘤药物，用于晚期胃癌 (AGC) 的治疗。索拉替尼（D错）是一种多激酶抑制剂。埃克替尼（E错）作用于EGFR，用于局部晚期或转移的非小细胞肺癌治疗。